下列哪一项属于公共卫生的核心功能
A. 评价
B. 制定政策
C. 保障
D. A+B
E. A+B+C

正确答案：E。A+B+C

解析：公共卫生的核心功能是：①评价，即定期系统地收集、整理、分析社区的健康信息，包括反映健康状况的统计学资料，社区卫生需求以及有关健康问题的流行病学和其他研究的资料，作出社区诊断；②制定政策，即推进公共卫生决策中科学知识的运用和引领公共卫生政策的形成，服务大众的利益；③保障，即通过委托、管理、或直接提供公共卫生服务来确保个人和社区获得必要的卫生服务，达到公众同意预设的目标。掌握“卫生系统及功能”知识点。